皮层薄壁细胞间隙中有间隙腺毛的是
A. 麻黄
B. 穿心莲
C. 广藿香
D. 细辛
E. 金钱草

正确答案：C。广藿香